在π=6.0％的总体中，随机抽取250例样本，得样本率p=6.3％，产生样本率与总体率不同的原因是
A. 样本量过大
B. 测量误差
C. 抽样误差
D. 混杂因素
E. 构成比不同

正确答案：C。抽样误差